甘草的功效是
A. 补气，养血
B. 补气，活血
C. 补气，解毒
D. 补气，养阴
E. 补气，燥湿

正确答案：C。补气，解毒

解析：本题考查的是甘草的功效。甘草的功效是补气，解毒（C对）。甘草：【功效】益气补中，祛痰止咳，解毒，缓急止痛，缓和药性。党参：【功效】补中益气，生津养血（A错）。刺五加：【功效】补气健脾，益肾强腰，养心安神，活血（B错）通络。山药：【功效】益气养阴（D错），补脾肺肾，固精止带。白术：【功效】补气健脾，燥湿（E错）利水，止汗，安胎。